患者近3年来，反复发作性胸部疼痛，胸闷不适，昨日因与人争吵诱发胸部疼痛，痛引肩背，气喘短促，肢体沉重，休息5分钟后缓解。病人形体肥胖，痰多舌淡，苔浊腻，脉滑，其病证结合诊断是
A. 不稳定型劳累性心绞痛，心血瘀阻证
B. 稳定型劳累性心绞痛，痰浊痹阻证
C. 不稳定型劳累性心绞痛，痰浊痹阻证
D. 心脏神经官能症，痰浊痹阻证
E. 稳定型劳累性心绞痛，心血瘀阻证

正确答案：B。稳定型劳累性心绞痛，痰浊痹阻证

解析：患者反复发作性胸部疼痛，胸闷不适，争吵后诱发，痛引肩背，休息5分钟后缓解为心绞痛的典型症状。病人气喘短促，肢体沉重，痰湿泛于肌肤故见形体肥胖，痰多，舌淡，苔浊腻，脉滑为痰浊痹阻型（B对）。心血瘀阻证症状：胸痛较剧，如刺如绞，痛有定处，入夜加重，伴有胸闷，日久不愈，或因暴怒而致心胸剧痛，舌质紫暗，或有瘀斑，舌下络脉青紫迂曲，脉弦涩或结代（AE错）。不稳定型心绞痛：①在相对稳定的劳累相关性心绞痛基础上出现逐渐增强的心绞痛（更重、持续时间更长或更频繁）。②新出现的心绞痛，通常在1个月内，由很轻度的劳力活动即可引起心绞痛。③在静息和很轻度劳力时出现的心绞痛（C错）。心脏神经官能症以心悸，胸痛，气短、乏力为主要表现，伴有其他神经症为特征，疼痛出现与劳力无关，疼痛部位与性质与典型心绞痛不同（D错）。